男，54岁。渐进性水肿半年，无糖尿病病史，Cr78μmol，C₃正常，NAN（—），蛋白尿（++），血压150/90mmHg。肾脏在光镜下的特征性病理表现
A. 内皮细胞和系膜细胞增生
B. 镜下无异常变化
C. 肾小球毛细血管壁增厚
D. 新月体形成
E. 肾小球无变化，肾小管及间质损伤

正确答案：C。肾小球毛细血管壁增厚

解析：患者男性，渐进性水肿半年，无糖尿病病史，Cr（血肌酐值）78μmol/L（正常值全血Cr为88.1～176.8μmol/L，血清或血浆Cr男性53～106μmol/L），蛋白尿强阳性，血压150/90mmHg（正常值小于140mmHg），符合肾病综合征的表现，患者年龄54岁，是膜性肾病的好发年龄段，因此首选病理类型应为膜性肾病，膜性肾病光镜下典型病例表现有毛细血管壁增厚，染色后可见增厚的基底膜和垂直的钉突（C对）。内皮细胞和系膜细胞增生常为急性肾小球肾炎（P469）的主要表现（P469）（A错）。肾病综合征光镜下一般都会出现相应的病理表现，极少出现光镜下无异常变化的情况（B错）。新月体形成为急进型肾小球肾炎的典型表现（P471）（D错）。肾小球无变化，肾小管及间质无损伤为微小病变性肾小球肾炎（P478）的常见表现（八版病理学P270）（E错）。